造成儿童青少年营养不良的膳食原因是
A. 碳水化合物供给不足
B. 蛋白质供给不足
C. 脂肪供给不足
D. 矿物质供给不足
E. 蛋白质和热能供给不足

正确答案：E。蛋白质和热能供给不足